患儿咳声重浊，连续不已，并有回声，日轻夜重。其诊断是
A. 顿咳
B. 喉炎
C. 白喉
D. 咳嗽
E. 肺炎喘嗽

正确答案：A。顿咳

解析：患儿咳声重浊，连续不已，并有回声，日轻夜重，符合顿咳的辩证要点（A对）。喉炎其症状一般就是“空空”样的咳嗽，有时称之为犬吠声，并可听到喉鸣声（B错）。白喉是一种传染病。白喉假膜多起于扁桃体，渐次蔓延于咽或鼻腔等处，其色灰白，不易擦去，若强力擦去则易出血，多有发热、喉痛、疲乏等症状，病情严重（C错）。咳嗽是小儿常见的一种肺系病证。有声无痰为咳，有痰无声为嗽，有声有痰谓之咳嗽（D错）。肺炎喘嗽以发热、咳嗽、痰壅、气急、鼻煽为主要症状，重者可见张口抬肩、呼吸困难、面色苍白、口唇青紫等症（E错）。